分叶状毛细胞血管瘤说法错误的是
A. 称化脓性肉芽肿
B. 好发于儿童和青年
C. 女性发病远超过男性
D. 生长迅速的外生性病变
E. 以牙龈、口唇、面部多见

正确答案：C。女性发病远超过男性

解析：分叶状毛细胞血管瘤亦称化脓性肉芽肿，为获得性血管瘤，是生长迅速的外生性病变。多认为是一种增生性而不是肿瘤性病变。常发生于皮肤或口腔黏膜，以牙龈、口唇、面部多见。呈息肉状，可有蒂，表面有溃疡。好发于儿童和青年，男性发病远超过女性。掌握“血管瘤及嗜酸性淋巴肉芽肿”知识点。